口腔科临床最常用的X线检查方法是
A. 根尖片
B. （牙合）片
C. （牙合）翼片
D. 华特位片
E. 颧弓位片

正确答案：A。根尖片

解析：本题考查根尖片。口腔科临床最常用的X线检查方法是根尖片（A对）。根尖片为口腔科临床最常用的X线检查方法，用于检查牙、牙周及根尖周病变。